牙本质粘接剂的粘接方式主要是
A. 机械性粘接
B. 化学性粘接
C. 机械与化学性粘接
D. 固位洞形
E. 以上都不是

正确答案：C。机械与化学性粘接

解析：本题考查牙本质粘接剂的粘接方式。牙本质粘接剂的粘接方式主要是微机械固位与化学粘结的结合（C对AB错）。固位洞形属于机械固位（D错）。